阵发性室上性心动过速的根治措施是
A. 直流电复律
B. 经食道超声起搏
C. 口服长效β受体拮抗剂
D. 口服长效维拉帕米
E. 射频消融术

正确答案：E。射频消融术

解析：阵发性室上性心动过速是由折返环存在引发的快速型心律失常，用导管消融技术（E对）可将其损毁，恢复正常心脏传导通路。若暂时不能行导管消融术者且又发作频繁和症状显著者，可考虑应用长效β受体阻滞剂（C错）、长效钙通道阻滞剂（D错）或洋地黄预防发作。